胆道结石，常表现
A. 慢性规律性的上腹痛
B. 无规律性的上腹痛
C. 右上腹绞痛
D. 左上腹剧痛
E. 全腹剧痛

正确答案：C。右上腹绞痛

解析：胆道结石，由于结石阻塞胆管，常表现为右上腹绞痛（C对）。慢性规律性上腹痛（A错）考虑为消化性溃疡。无规律性上腹痛（B错）考虑为慢性胃炎或胃癌等等。左上腹剧痛（D错）可考虑脾破裂。全腹剧痛（E错）考虑弥漫性腹膜炎。